关于罂粟壳使用管理要求的规定，下列正确的有
A. 处方须有麻醉药处方权的执业医师签名
B. 须使用麻醉药专用处方方可调配
C. 成人一次正常用量为每天3～6g
D. 每张处方不得超过7日用量
E. 须与群药一起调配

正确答案：A、B、C、D、E。处方须有麻醉药处方权的执业医师签名；须使用麻醉药专用处方方可调配；成人一次正常用量为每天3～6g；每张处方不得超过7日用量；须与群药一起调配

解析：本题考查的是罂粟壳的用法用量及调剂。关于罂粟壳使用管理要求的规定，下列正确的有处方须有麻醉药处方权的执业医师签名（A对）、须使用麻醉药专用处方方可调配（B对）、成人一次正常用量为每天3～6g（C对）、每张处方不得超过7日用量（D对）与须与群药一起调配（E对）。罂粟壳的用法用量及调配：罂粟壳也称米壳，其炮制规格有生罂粟壳和蜜罂粟壳，处方用名罂粟壳时给付蜜罂粟壳。罂粟壳具有敛肺止咳，涩肠，定痛的功效。治久咳，久泻，久痢，脱肛，便血，心腹筋骨诸痛，滑精，多尿，白带等病证，临床使用时的用量一般在3～6g。本品有成瘾性，故不宜常服，孕妇及儿童禁用，运动员慎用。罂粟壳必须凭有麻醉药处方权的执业医师签名的淡红色麻醉药处方方可调配，应于群药中，且与群药一起调配，不得单方发药，每张处方不得超过三日用量，连续使用不得超过7天，成人一次的常用量为每天3～6g。处方保存3年备查。